高温强辐射热作业人体散热的最主要方式
A. 辐射
B. 传导
C. 对流
D. 蒸发

正确答案：D。蒸发

解析：本题考查高温强辐射作业人体散热方式。皮肤是散热的主要部位，蒸发（D对ABC错）散热是最重要而有效的散热方式。气象因素可以影响人体热平衡，例如风（气流）大可加强对流和蒸发，而高湿度则抑制蒸发散热，高温强辐射作业又称干热作业，其湿度较小，蒸发散热是重要的散热方式。